心力衰竭治疗中应用硝普钠是为了
A. 降低心脏前负荷
B. 降低心脏后负荷
C. 两者均有
D. 两者均无
E. 无

正确答案：C。两者均有

解析：减轻心脏前后负荷是心衰防治原则之一，硝普钠可直接松弛小动脉和静脉平滑肌，静脉舒张使回心血量减少，心室舒张期充盈压（前负荷）降低。动脉舒张使心室射血时阻力（后负荷）降低。因而硝普钠可降低心脏前、后负荷（AB对，故C为本题正确答案）。